女，25岁。停经7周，1h前突感下腹部疼痛，伴肛门坠胀感。査体：皮肤苍白，下腹压痛反跳痛腹肌紧张，阴道后穹窿饱满，有压痛。为确诊，最可靠的检査是
A. 血常规
B. B型超声
C. 阴道后穹窿穿刺
D. 粪常规
E. 结核菌素试验

正确答案：C。阴道后穹窿穿刺

解析：育龄期女性，停经7周（输卵管妊娠常有6～8周的停经史），突发下腹痛，伴肛门坠胀感（典型症状为停经后腹痛与阴道流血，输卵管妊娠破裂时突感一侧下腹部撕裂样疼痛），皮肤苍白（输卵管妊娠破裂时疼痛和出血引起），下腹部压痛、反跳痛、腹肌紧张（腹部检查：下腹有明显压痛及反跳痛，尤以患侧为著，但腹肌紧张轻微），阴道后穹隆饱满，有压痛（输卵管妊娠流产或破裂者，阴道后穹隆饱满，有触痛），最可能的诊断是输卵管妊娠破裂出血。阴道后穹窿穿刺（C对）是一种简单可靠的检查方法，适用于疑有腹腔出血的患者，抽出不凝血即可确诊。B型超声（P54）（B错）对异位妊娠诊断必不可少，在异位妊娠未流产和破裂时，探及胚芽和原始胎心搏动，明确异位妊娠部位和大小，但是当异位妊娠破裂以后B超已不能探及宫外的胚芽及胎心搏动，只能在探及宫旁混合回声及子宫直肠窝游离暗区时，高度怀疑异位妊娠，不能明确诊断。血常规（A错）、粪常规（D错）以及结核菌素试验（E错）与输卵管妊娠破裂的诊断无关。